关于大隐静脉，何者为错
A. 穿深筋膜入股静脉
B. 沿小腿及大腿内侧上行
C. 起自足背静脉弓内侧
D. 行经内踝后方
E. 壁内有多对静脉瓣防止血液逆流

正确答案：D。行经内踝后方

解析：大隐静脉穿深筋膜入股静脉（A对）。沿小腿及大腿内侧上行（B对）。起自足背静脉弓内侧（C对）。经内踝前方（D错，为本题正确答案）。